舍格伦综合征区别于其他涎腺慢性炎症的病理表现为
A. 从腺小叶中心淋巴细胞密集浸润
B. 腺小叶内导管形成上皮肌上皮岛
C. 腺小叶内腺泡全部消失，小叶轮廓仍保留，腺小叶缺乏纤维结缔组织
D. 腺小叶内导管增生扩张，形成囊腔或变性液化
E. 病变小叶与正常腺小叶有界限，但无被膜间隔

正确答案：C。腺小叶内腺泡全部消失，小叶轮廓仍保留，腺小叶缺乏纤维结缔组织

解析：舍格伦综合征腺体的镜下观：小叶内腺泡全部消失，而为淋巴细胞、组织细胞所取代，但小叶外形轮廓仍保留。腺小叶内缺乏纤维结缔组织修复，此表现可区别于腺体其他慢性炎症。掌握“坏死性唾液腺化生与舍格伦综合征”知识点。